生物学刺激物属于
A. 环境性应激源
B. 心理性应激源
C. 社会性应激源
D. 职业性应激源
E. 生活性应激源

正确答案：A。环境性应激源

解析：环境性应激源：各种特殊环境、理化和生物学刺激物。掌握“心理应激”知识点。